窝沟封闭固化照射时间一般为
A. 10～20S
B. 20～40S
C. 40～60S
D. 60S
E. 100S

正确答案：B。20～40S

解析：自凝封闭剂涂布后1～2分钟即可自行固化。光固封闭剂涂布后，立即用可见光源照射。照射距离约离牙尖1mm，照射时间要根据采用的产品类型与可见光源性能决定，一般约为20～40秒。照射的部位要大于封闭剂涂布的部位。掌握“窝沟封闭术”知识点。